可使髋关节旋内和旋外的肌是
A. 长收肌
B. 梨状肌
C. 臀小肌
D. 臀大肌
E. 大收肌

正确答案：C。臀小肌

解析：长收肌（A错）和大收肌（E错）使髋关节内收和旋外。梨状肌（B错）使髋关节外展和旋外。臀小肌（C对）使髋关节外展、旋内（前部肌束）和旋外（后部肌束）。臀大肌（D错）使髋关节伸和旋外。